一外伤患者经X线证实为上颌前部牙槽突骨折，伴牙龈撕裂。以下处理措施中，哪项是不必要的
A. 缝合撕裂牙龈
B. 复位上颌牙槽突
C. 单颌结扎固定
D. 颌间结扎固定
E. 调（牙合），避免上下前牙早接触

正确答案：D。颌间结扎固定

解析：颌间固定：指利用牙弓夹板将上、下颌固定在一起的方法，是颌面外科最常使用的固定方法。它的优点是能使移位的骨折段保持在正常咬合关系上愈合。常用的方法有：带钩牙弓夹板颌间固定、小环颌间结扎固定和正畸托槽颌间固定。牙槽突的骨折一般单颌固定即可，不需要颌间结扎固定。单颌固定：是指在发生骨折的颌骨上进行固定，而不将上、下颌骨同时固定在一起的方法。常用的有单颌牙弓夹板固定：即将成品或弯制的牙弓夹板横跨骨折线安置到两侧健康牙上，用金属丝将夹板与牙体逐个结扎起来，利用健康牙固定骨折的方法。临床上常用于牙槽突骨折和移位不大的颏部线形骨折。掌握“牙槽突骨折、颌骨骨折”知识点。